确诊胃十二指肠溃疡首选的检查是
A. 上消化道造影
B. 腹部超声
C. 胃镜
D. 腹部增强CT
E. 内镜超声

正确答案：C。胃镜

解析：胃镜检查可以确定有无病变、部位及分期，鉴别良恶性溃疡，对合并出血者给予止血治疗，对合并狭窄梗阻病人给予扩张或支架治疗，因此胃镜检查（C对）是PU诊断的首选方法和金标准。随着内镜技术的普及和发展，上消化道钡剂造影应用得越来越少，可了解胃的运动情况，适用于胃镜禁忌者及不愿接受胃镜检查者和没有胃镜检查条件时（A错）。腹部超声检查对空腔脏器疾病的诊断价值不大（B错）。对于消化性溃疡并发症如穿透性溃疡或穿孔，腹部增强CT（D错）很有价值，可以发现穿孔周围组织炎症、包块、积液，对于游离气体的显示甚至优于立位胸片，但是诊断PU仍然首选胃镜检查。内镜超声检查（E错）可评估胃或十二指肠壁、溃疡深度、病变与周围器官的关系、淋巴结数目和大小等，但在诊断PU时仍首选胃镜检查。